男，60岁。寒战高热伴肝区疼痛15天，腹部CT提示肝内2个脓肿，最大直径达6cm，体温每日高达39.8℃左右，其治疗方法应首选
A. 经皮穿刺置管引流术
B. 右半肝切除术
C. 脓腔内注入抗生素
D. 全身大剂量应用抗生素
E. 继续支持治疗

正确答案：A。经皮穿刺置管引流术

解析：患者肝内脓肿最大直径6cm、高热，症状严重，其治疗方法应首选经皮穿刺置管引流术（A对），可有效引流脓液，减轻症状。肝切除术（B错）适用于慢性厚壁肝脓肿等。脓腔内注入抗生素需在经皮穿刺置管引流术后进行（C错）。患者有症状15天后开始治疗，全身大剂量应用抗生素（D错）、继续支持治疗（E错）等非手术治疗效果有限，应作为辅助治疗方法。